与OLP发病因素无关的有
A. 神经精神因素
B. 病毒感染
C. 过度吸烟饮酒
D. 免疫学因素
E. 某些化学药物、可能的遗传因素

正确答案：C。过度吸烟饮酒

解析：本题考查口腔扁平苔藓的发病因素。过度吸烟可引起口腔白斑病（C错，为本题的正确答案）。OLP（口腔扁平苔藓）是一种常见的口腔黏膜慢性炎性疾病，其病因及发病机制尚不明确，可能与多种致病因素有关，包括：免疫学因素（D对），神经精神因素（A对），内分泌因素、病毒感染（B对）、微循环障碍、遗传因素、系统性疾病以及口腔局部刺激因素等。某些化学药物也可引起口腔扁平苔癣（E对）。